经食物传播的传染病
A. 发病往往有年龄差异
B. 有时可造成暴发流行
C. 两种流行特征都有
D. 两种流行特征都无

正确答案：B。有时可造成暴发流行

解析：本题考查经食物传播的传染病的流行特征。经食物传播的传染病的流行特征有：①病人有进食相同食物史，不食者不发病；②病人的潜伏期短，一次大量污染可引起暴发（B对ACD错）；③停止供应污染食物后，暴发或流行即可平息；④如果食物被多次污染，暴发或流行可持续较长的时间。